采用高选择性迷走神经切断术治疗十二指肠溃疡，主要依据是
A. 溃疡很少恶变
B. 能够减少胃酸分泌
C. 患者年龄大于70岁
D. 能防治幽门螺杆菌感染
E. 溃疡病灶小

正确答案：B。能够减少胃酸分泌

解析：胃的运动和分泌主要受交感神经和迷走神经支配，迷走神经兴奋时胃的运动和分泌增强。左、右迷走神经沿食管右侧下行，左支在贲门腹侧面分出肝胆支和胃前支，右支在贲门背侧面分出腹腔支和胃后支。胃前、后支沿胃小弯下行，并发出分支进入胃壁，其终末分支‘鸦爪’支进入胃窦，控制胃窦的运动和幽门的排空。高选择性迷走神经切断术切断了胃近端、胃底和胃体部的迷走神经，使胃酸分泌减少，保留了支配胃窦部的“鸦爪”支。十二指肠溃疡的发生与基础胃酸分泌增高密切相关，因此采用高选择性迷走神经切断术治疗十二指肠溃疡的主要依据是能够减少胃酸分泌（B对）。